左心衰竭引起肺循环淤血主要表现是
A. 下肢水肿
B. 呼吸困难
C. 心律失常
D. 肝肿大压痛
E. 颈静脉怒张

正确答案：B。呼吸困难

解析：左心衰竭时，左室输出量减少，导致心脏舒张期充盈压升高，肺循环血液回流受阻，造成肺循环淤血。肺循环淤血可引起肺顺应性降低、气道阻力增加等，临床表现为呼吸困难（B对）。同理可得，右心衰时可出现体循环淤血，临床表现为下肢水肿（A错）、肝肿大压痛（D错）、颈静脉怒张（E错）等。